医学道德情感不包括哪条内容
A. 同情感
B. 责任感
C. 事业感
D. 公正感
E. 愧疚感

正确答案：E。愧疚感

解析：医学道德情感是建立在医务人员对患者的生命价值、人格和权利尊重的基础上，表现出对患者、对医学事业的真挚热爱，是一种高尚的情感，这种情感具有自觉性、纯洁性和理智性的特点。内容包括：①同情感：是每个医务人员都应具有的最起码的医学道德情感。②责任感：把挽救患者的生命、促进患者的康复视为自己的崇高职责和义不容辞的责任。③事业感：是高层次的医学道德情感，把本职工作与发展医学事业紧密地联系起来，把医学事业看得高于一切，并成为执著的终身追求。医务人员对患者的责任感，促使其关心、体贴患者，也可以使患者产生良好的心理效应，有利于建立和谐的医患关系和患者早日康复。公正是指医务人员应具有公平合理的协调医学伦理关系的品德；对待患者要一视同仁，公平公正；分配医疗资源要公平合理；处理易患纠纷要公正无私；所以医务人员也要有公正感（E错，为本题正确答案）。